心室肌细胞有效不应期相当于
A. 收缩期
B. 舒张期
C. 收缩期﹢舒张早期
D. 收缩期﹢舒张期
E. 舒张晚期

正确答案：C。收缩期﹢舒张早期